在牙周手术的愈合过程中，优先占据根面的细胞通常是
A. 牙槽骨骨髓细胞
B. 牙龈结缔组织细胞
C. 牙龈上皮细胞
D. 牙周膜细胞
E. 成牙骨质细胞

正确答案：C。牙龈上皮细胞

解析：本题考查牙周手术的愈合过程。在牙周手术的愈合过程中，龈瓣与根面之间首先由血凝块连接，之后牙龈上皮、牙龈结缔组织、牙周膜、牙槽骨4种来源的细胞先后向根面生长贴附,最终的愈合方式取决于上述4种细胞的生长速度及条件。一般情况下，牙龈上皮细胞（C对）生长最快，首先占据了根面，形成长结合上皮愈合，并阻止了其他组织与根面贴附，因此这是最常见的愈合方式。牙龈结缔组织细胞（B错）的生长速度仅次于上皮细胞，如果这类细胞有条件首先接触根面，则可形成与根面平行的胶原纤维，而且容易发生牙根吸收。牙槽骨骨髓细胞（A错）生长速度最慢，若有条件接触根面，则较容易发生骨固连或牙根吸收。牙周膜细胞（D错）的生长速度慢于上皮和结缔组织，只在袋底附近的牙周膜细胞能优先占据根面，但机会很少。如果牙周膜细胞能够优先向冠方生长，占据根面，其中的前体细胞能分化出成牙骨质细胞（E错）、成骨细胞和成纤维细胞，在根面沉积新的牙骨质，形成新的牙周膜纤维埋入其中，胶原纤维的另一端埋入新形成的牙槽骨中，形成再生性愈合，是最理想的愈合方式。